既能润肺止咳，又能润肠通便的药物是
A. 郁李仁
B. 薏苡仁
C. 杏仁
D. 火麻仁
E. 酸枣仁

正确答案：C。杏仁

解析：杏仁苦，微温；归肺、大肠经；功效是降气止咳平喘，润肠通便（C对）。郁李仁（A错）的功效是润肠通便，利水消肿。薏苡仁（B错）的功效是利水渗湿，健脾止泻，除痹，排脓，解毒散结。火麻仁（D错）的功效是润肠通便。酸枣仁（E错）的功效是养心补肝，宁心安神，敛汗，生津。